下列疾病均属于自身免疫病的是
A. 多形红斑、天疱疮、红斑狼疮
B. 天疱疮、类天疱疮、红斑狼疮
C. 类天疱疮、多形红斑、红斑狼疮
D. 白塞病、红斑狼疮、血管神经性水肿
E. 红斑狼疮、血管神经性水肿、多形红斑

正确答案：B。天疱疮、类天疱疮、红斑狼疮

解析：本题考查自身免疫病。天疱疮是一类严重的、慢性的黏膜-皮肤自身免疫大疱性疾病；大疱性类天疱疮是类天疱疮中的一个类型，也是一种慢性自身免疫性的皮肤黏膜病；盘状红斑狼疮多认为是一种自身免疫性疾病（B对）。多形性红斑（AC错）是黏膜皮肤的一种急性渗出性炎症性疾病。白塞病（D错）是一种慢性血管炎症性疾病。血管神经性水肿（DE错）为一种急性局部反应型的黏膜皮肤水肿，发病机制属Ⅰ型超敏反应。